评价经干预后健康状况和社会效益的变化属于
A. 过程评价
B. 效应评价
C. 形成评价
D. 近期效果评价
E. 远期效果评价

正确答案：E。远期效果评价